通草的药用部位是
A. 茎髓
B. 茎刺
C. 茎藤
D. 茎枝
E. 心材

正确答案：A。茎髓

解析：本题考查的是通草的药用部位。通草的药用部位是茎髓（A对）。药用部位为植物的茎藤、茎枝、茎刺或茎的髓部，这类中药称“茎类中药”。药用部位为木本植物茎藤（C错）的，如川木通、大血藤、鸡血藤等；药用部位为带叶茎枝（D错）的，如桑寄生、槲寄生；药用部位为嫩枝的，如桂枝、桑枝等；药用部位为棘刺（B错）的，如皂角刺；药用部位为茎翅状附着物的，如鬼箭羽；药用部位为茎髓的，如通草、灯心草；药用部位为新鲜或干燥茎的，如石斛等。